下列不属于年轻恒牙牙髓炎的致病因素是
A. 龋病
B. 牙齿结构异常
C. 牙外伤
D. 医源性因素
E. 拔牙所致

正确答案：E。拔牙所致

解析：年轻恒牙牙髓炎多由龋病引起。牙齿结构异常、外伤、创伤、医源性因素也可引起。掌握“年轻恒牙牙髓病及根尖周病诊断及治疗”知识点。